男性，20岁。上前牙外伤缺损7天。无自觉症状。口腔检查：右上1近中切角缺损，切龈径大于牙冠的2/3，未穿通髓腔，温度刺激试验（+），叩诊（-），无松动。X线片示：无根折，较恰当的处理是
A. 钉固位银汞合金修复术
B. 钉固位玻璃离子修复术
C. 钉固位复合树脂修复术
D. 钉固位磷酸锌黏固粉修复术
E. 牙髓治疗后烤瓷冠修复术

正确答案：C。钉固位复合树脂修复术

解析：本题考查前牙牙体缺损修复体的临床应用选择。该患者牙外伤后无自觉症状，牙体组织缺损范围小，牙髓活力存，无松动，无叩痛，X线片显示无根折，故可将锐利边缘调磨光滑以后，制备粘接斜面或钉固位形，进行复合树脂修复，即钉固位复合树脂修复术（C对）。因银汞合金美观性差，故钉固位银汞合金修复术（A错）一般不用于前牙的修复。玻璃离子具有良好的粘结性、生物相容性和释氟性，但物理机械性能较差，弹性模量较低，脆性较大，抗张强度和抗压强度均小于复合树脂，美观性也较复合树脂差，故不宜选用钉固位玻璃离子修复术（B错）。钉固位磷酸锌黏固粉修复术（D错）中所用的磷酸锌黏固粉内的游离磷酸可对牙髓产生刺激，故不宜用于活髓牙。该患牙仅有小范围的切角损害，牙髓活力存，不应进行牙髓治疗，故无需进行牙髓治疗后烤瓷冠修复术（E错）。